女，56岁。右颌下颈部肿痛5天，伴发热39℃，无寒战，诊为急性蜂窝织炎，其最危险的后果是
A. 扩散至面部
B. 扩散至上纵隔
C. 扩散为脓毒症
D. 引发吞咽困难、呕吐
E. 引起呼吸困难、窒息

正确答案：E。引起呼吸困难、窒息